男，45岁。平素体健。为抢救一外伤的幼儿献血100ml，如果不考虑交感/副交感神经兴奋性，最可能的血压、心率变化是
A. 心率和血压均无明显变化
B. 血压升高，心率加快
C. 血压升高，心率减慢
D. 血压降低，心率加快
E. 血压降低，心率减慢

正确答案：A。心率和血压均无明显变化

解析：正常60kg体重的人血量为4.2～4.8L，该成年男性献血100ml不超过血量的10%，一般不会引起心率和血压均无明显变化（A对）。